下列罐头可食用的是
A. 超过保存期
B. 漏听
C. 生物性胖听
D. 物理性胖听
E. 罐头内容物外观正常，酸度增加

正确答案：D。物理性胖听